我国成年人膳食中脂肪提供能量占全日摄入总能量的适宜百分比为
A. 12%～15%
B. 50%～60%
C. 20%～30%
D. 10%～12%
E. 10%～15%

正确答案：C。20%～30%